处方一般不得超过几日用量
A. 1日
B. 3日
C. 5日
D. 7日
E. 10日

正确答案：D。7日

解析：处方一般不得超过7日（D对）用量。急诊处方一般不得超过3日（B错）用量；对于某些慢性病、老年病或特殊情况，处方用量可适当延长，但医师应当注明理由。